女，50岁。皮肤、巩膜黄染2个月。进行性加重，伴厌食、乏力。大便灰白，体重减轻3Kg。查体：皮肤、巩膜黄染，肝肋下3cm，边缘钝，无结节，可触及肿大胆囊，Murphy征（-）。血清总胆固醇、结合胆红素、ALP、γ-GT均显著升高，CA199升高。首选的影像学检查是
A. 核素扫描
B. 腹部CT
C. MRCP
D. 腹部MRI
E. 腹部B超

正确答案：E。腹部B超

解析：中老年女性，皮肤、巩膜黄染2个月（黄疸），进行性加重，伴厌食、乏力。大便灰白（胆管癌典型表现），体重减轻3Kg。查体：皮肤、巩膜黄染，肝肋下3cm（肝大），边缘钝，无结节，可触及肿大胆囊，Murphy征（-）。血清总胆固醇、结合胆红素、ALP、γ-GT均显著升高，CA19-9升高。综合患者的病史、临床症状、体查、实验室检查，诊断考虑为胆管癌，首选的影像学检查是腹部B超（E对），可见肝内胆管扩张或胆管肿物，并可在超声导引下行PTC检查，穿刺抽取胆汁作CEA、CA19-9、胆汁细胞学检查和直接穿刺肿瘤活检。腹部CT（B错）、MRI（D错）、磁共振胆胰管成像（MRCP）（C错）能显示胆道梗阻的部位、病变性质等，核素扫描（A错）、血管造影有助于了解癌肿与血管的关系，有助于胆管癌诊断，但均不是首选检查。